牙列缺损最常见原因是
A. 龋病和外伤
B. 龋病和牙髓炎
C. 龋病和牙龈炎
D. 龋病和牙周病
E. 龋病和根尖周病病

正确答案：D。龋病和牙周病

解析：目前最常见原因仍然是龋病和牙周病。掌握“牙列缺损病因及影响”知识点。